不符合急性心包炎的心电图变化
A. 弓背向下型ST段抬高
B. T波平坦或倒置
C. QRS波呈低电压
D. 电交替
E. 弓背型向上的ST抬高

正确答案：E。弓背型向上的ST抬高

解析：急性心包炎的心电图变化主要为除aVR和V₁导联以外的所有常规导联可能出现ST段呈弓背向下型抬高（A对），而弓背形向上的ST抬高（E错，为本题正确答案）常见于急性心肌梗死患者；QRS波多呈低电压（C对），之后逐渐出现T波低平及倒置（B对）；若急性心包炎伴大量心包积液时可出现QRS电交替（D对）。